非药品不得
A. 有涉及药品的宣传广告
B. 在大众传媒发布广告
C. 发布广告
D. 在零售药店销售
E. 在医学、药学专业刊物上介绍

正确答案：A。有涉及药品的宣传广告

解析：本题考查药品广告管理。非药品不得有涉及药品的宣传广告（A对）。药品广告的内容应当真实、合法，以国务院药品监督管理部门核准的药品说明书为准，不得含有虚假的内容。药品广告不得含有表示功效、安全性的断言或者保证；不得利用国家机关、科研单位、学术机构、行业协会或者专家、学者、医师、药师、患者等的名义或者形象作推荐、证明。非药品广告不得有涉及药品的宣传。